属于Kennedy第二类二亚类的是
A. 18，17，12，11，21，22，26，27，28缺失
B. 16，14，13，12，11，21，22，23，26，27，28缺失
C. 14，13，12，11，21，22缺失
D. 13，12，11，21，22，27，28缺失
E. 14，13，12，11，21，22，23，26缺失

正确答案：B。16，14，13，12，11，21，22，23，26，27，28缺失

解析：本题考查Kennedy牙列缺损分类。属于Kennedy第二类二亚类的是16，14，13，12，11，21，22，23，26，27，28缺失（B对）。18，17，12，11，21，22，26，27，28缺失为Kennedy第一类第一亚类（A错）；16，14，13，12，11，21，22，23，26，27，28缺失为Kennedy第二类第二亚类；14，13，12，11，21，22缺失为Kennedy第四类（C错）；13，12，11，21，22，27，28缺失为Kennedy第二类第一亚类（D错）；14，13，12，11，21，22，23，26缺失为Kennedy第三类第一亚类（E错）。